眼前房与眼后房的分界是
A. 睫状体
B. 虹膜
C. 晶状体
D. 玻璃体

正确答案：B。虹膜

解析：虹膜将眼房分为前房和后房，即眼前房与眼后房的分界是虹膜（B对）。